影响胃肠道吸收的因素有
A. 化学物质的分子结构
B. 化学物质的理化特性
C. 胃肠蠕动情况
D. 胃肠菌群环境
E. 以上都是

正确答案：E。以上都是